胎心率早期减速的原因
A. 胎儿缺氧
B. 胎动
C. 子宫收缩
D. 胎头受压
E. 胎盘功能減低

正确答案：D。胎头受压

解析：胎心率早期减速的原因为宫缩时胎头受压（D对），胎心率晚期减速的原因一般认为是胎盘功能不良（E错）、胎儿缺氧（A错）。胎动（B错）和子宫收缩（C错）仅能引起胎心率一过性变化。